治疗子肿气滞证，应首选
A. 丹栀逍遥散
B. 乌药汤
C. 通窍活血汤
D. 天仙藤散
E. 龙胆泻肝汤

正确答案：D。天仙藤散

解析：丹栀逍遥散功能养血健脾，疏肝清热，主治肝郁血虚，内有郁热证（A错）。乌药汤功能行气活血，调经止痛，主治肝郁气滞证（B错）。通窍活血汤功能活血通窍，为治疗经行头痛血瘀证的选方（C错）。子肿气滞证治宜理气行滞，除湿消肿，方选天仙藤散（D对）。龙胆泻肝汤功能清肝泻火，主治肝胆实火上炎证及肝经湿热下注证（E错）。